男性，65岁。进行性排尿困难1年，不能自行排尿8小时。膀胱膨隆，轻压痛。首选的治疗方法应是
A. 针灸
B. 耻骨上膀胱穿刺
C. 导尿并保留导尿管
D. 耻骨上膀胱造瘘
E. 药物治疗

正确答案：C。导尿并保留导尿管

解析：老年男性患者，进行性排尿困难1年，不能自行排尿8小时，膀胱膨隆，轻压痛，结合患者病史和临床表现，考虑该患者为前列腺增生所致急性尿潴留。急性尿潴留治疗原则是解除病因，恢复排尿，急诊处理可行导尿术。患者已有膀胱膨隆，故当前首选的治疗方法应是导尿并保留导尿管（C对），以缓解尿潴留症状。针灸（A错）可用于动力性尿潴留。耻骨上膀胱穿刺（B错）、耻骨上膀胱造瘘（D错）主要用于插入导尿管失败的患者。药物治疗（E错）起效较慢，不能用于已发生急性尿潴留的患者。